测量附着水平，恰当距离是
A. 龈缘-釉质牙骨质界
B. 牙颈部-袋底
C. 龈缘-袋底
D. 釉质骨质界-袋底
E. 牙颈部-釉质牙骨质界

正确答案：D。釉质骨质界-袋底

解析：本题考查附着水平的测量。测量附着水平，恰当距离是釉质骨质界-袋底（D对）。牙周附着水平是指龈沟底或牙周袋底至釉牙骨质界的距离。龈缘至釉牙骨质界（A错）是龈沟的深度，而不是测量附着水平。牙颈部-袋底（B错）：牙颈部不是一个确定的位置点（E错）。龈缘至袋底（C错）的深度为探诊深度。